治疗强心苷中毒引起的室性心律失常最好选用
A. 奎尼丁
B. 普萘洛尔
C. 利多卡因
D. 维拉帕米
E. 苯妥英钠

正确答案：E。苯妥英钠

解析：本题考查苯妥英钠。苯妥英钠（E对）常用来治疗强心苷中毒引起的室性心律失常。奎尼丁（A错）是一种广谱抗心律失常的药物。普萘洛尔（B错）为β受体抑制剂，可以降低自律性，减慢传导，主要用于室上型心律失常。利多卡因（C错）是急性心肌梗死的室性早搏，室性心动过速及室性震颤的首选药。维拉帕米（D错）适用于心绞痛，室上性心律失常，原发性高血压等。